阿仑膦酸钠适宜的给药方法包括
A. 早餐前空腹服药
B. 用大量温开水送服
C. 服药后30分钟内保持立位
D. 早餐后30分钟服
E. 宜与碳酸钙同时服用

正确答案：A、B、C。早餐前空腹服药；用大量温开水送服；服药后30分钟内保持立位

解析：本题考查阿仑膦酸钠的给药方法。为便于吸收，减少对食管的刺激，阿仑膦酸钠应早晨空腹给药（A对D错），并建议足量水送服（B对），保持坐位或立位，服后30分钟（C对）不宜饮食或卧床，不宜喝牛奶、咖啡等饮料或与其它药物同服（E错）。